属于腹腔干的分支是
A. 胃网膜左动脉
B. 胃网膜右动脉
C. 胃短动脉
D. 胃右动脉
E. 胃左动脉

正确答案：E。胃左动脉

解析：胃左动脉（E对）、肝总动脉和脾动脉为腹腔干的三大分支。